阿片受体阻断剂是
A. 喷他佐辛
B. 罗通定
C. 曲马多
D. 芬太尼
E. 纳洛酮

正确答案：E。纳洛酮